乳牙髓腔感染易引起根分叉处骨吸收的主要原因是
A. 乳牙髓室底较薄易折裂
B. 乳牙钙化差髓室底易被龋蚀穿通
C. 乳牙吸收是从根分叉处开始
D. 乳牙髓室底多副根管通达根分叉处
E. 以上均是

正确答案：D。乳牙髓室底多副根管通达根分叉处

解析：本题考查乳牙牙髓腔形态。乳磨牙的髓底多见副根管通达根分叉处（D对），乳牙髓腔感染炎症易沿髓室底处的副根管扩散至根分叉处，引起根分叉处骨吸收。乳牙髓室底较薄只有受外力时才会折裂（A错），乳牙虽然钙化差但髓室底距离牙齿表面远不易被龋蚀穿通（B错），当乳磨牙的继承恒牙萌出时乳牙吸收是从根分叉处开始（C错）这些情况发生时，髓腔感染有可能会引起根分叉处骨吸收，但少见，乳牙髓室底多副根管通达根分叉处才是乳牙髓腔感染易引起根分叉处骨吸收的主要原因。